发生原因不明的疾病暴发或流行时，从流行病学角度，主要的工作点是
A. 首先隔离患者，防止进一步传播
B. 分析不同治疗方法的效果，探索可能病因
C. 调查该病分布特点，判断蔓延途径和原因
D. 调查分析该病临床表现，依靠多种检查作出诊断
E. 寻找各病例间的关联，以推测病因

正确答案：C。调查该病分布特点，判断蔓延途径和原因